气血瘀滞证的舌象是
A. 舌色淡红
B. 舌质淡白
C. 舌质绛红
D. 舌质紫暗
E. 舌起粗大红刺

正确答案：D。舌质紫暗

解析：气血瘀滞，瘀血阻于舌络则见舌质紫黯或紫红（D对）。正常舌质淡红（A错）。若舌质淡白为气血虚亏（B错）。温热病邪入营血，则见舌质绛红，舌有红刺（C错）。舌起粗大红刺，状如草莓者，常见于猩红热（E错）。